每个社区卫生服务中心每年至少开展（）次公众健康咨询活动
A. 5
B. 6
C. 7
D. 8
E. 9

正确答案：E。9